以细菌为主的多种因素作用下，牙体硬组织发生的慢性、进行性破坏的一种疾病
A. 龋病
B. 牙周病
C. 根尖周炎
D. 颌骨囊肿
E. 牙体磨耗

正确答案：A。龋病

解析：龋病是在以细菌为主的多种因素作用下，牙体硬组织发生的慢性、进行性破坏的一种疾病。掌握“龋病概述”知识点。